以下情况予以处罚医院一万元罚款的是
A. 未对放射诊疗工作人员进行健康检查
B. 科室成员未按科室规章制度诊疗
C. 私自设立科室
D. 各科室人员混乱
E. 未经批准设立放射科

正确答案：A。未对放射诊疗工作人员进行健康检查

解析：根据《放射诊疗管理规定》第六章法律责任第四十一条，医疗机构违反本规定，有下列行为之一的，由县级以上卫生行政部门给予警告，责令限期改正；并可处1万元以下的罚款：（一） 购置、使用不合格或国家有关部门规定淘汰的放射诊疗设备的；（二） 未按照规定使用安全防护装置和个人防护用品的；（三） 未按照规定对放射诊疗设备、工作场所及防护设施进行检测和检查的；（四） 未按照规定对放射诊疗工作人员进行个人剂量监测、健康检查（A对）、建立个人剂量和健康档案的；（五） 发生放射事件并造成人员健康严重损害的；（六） 发生放射事件未立即采取应急救援和控制措施或者未按照规定及时报告的；（七） 违反本规定的其他情形。